旋覆代赭汤证的病因病机是
A. 痰热内阻，胃失和降
B. 食积内停，胃失和降
C. 胃虚痰阻，气逆不降
D. 胃虚有热，气逆不降
E. 胃中虚冷，气逆不降

正确答案：C。胃虚痰阻，气逆不降

解析：本题考查旋覆代赭汤的病因病机，属于理解记忆内容。旋覆代赭汤因胃气虚弱，痰浊内阻（C对）所致，没有热像，所以（ADE错）。痰浊内阻是由胃气虚弱导致，不是由食积内停导致的，所以（B错）。